寨卡病毒的传播途径不包括
A. 伊蚊叮咬传播
B. 母婴传播
C. 血液传播
D. 性传播
E. 飞沫传播

正确答案：E。飞沫传播